沉香源于瑞香科植物，其性能特点有
A. 温而不燥
B. 行而不泄
C. 无破气之害
D. 辛香行散温通
E. 味苦质重下行

正确答案：A、B、C、D、E。温而不燥；行而不泄；无破气之害；辛香行散温通；味苦质重下行

解析：本题考查的是沉香的性能特点。沉香源于瑞香科植物，其性能特点有温而不燥（A对）、行而不泄（B对）、无破气之害（C对）、辛香行散温通（D对）与味苦质重下行（E对）。沉香：【性能特点】本品辛香行散温通，味苦质重下行。入脾、胃经，既行气温中而止痛，又降胃气而止呕。入肾经，善温肾纳气平喘。集理气、降逆、纳气于一身，且温而不燥、行而不泄，无破气之害，故为理气良药。